血吸虫病的传播途径
A. 呼吸道
B. 消化道为主
C. 呼吸道和消化道
D. 皮肤粘膜接触
E. 蚊子媒介

正确答案：D。皮肤粘膜接触

解析：本题考查血吸虫病的传播途径。血吸虫病属于经疫水传播的传染病，通过皮肤、黏膜（D对ABCE错）接触被污染的疫水而被感染。